振动本身特性中，对机体作用的主要影响因素是
A. 加速度、频率、位移
B. 位移、振幅、加速度
C. 接触方式、加速度、位移
D. 频率、振幅、加速度
E. 振幅、频率、速度

正确答案：D。频率、振幅、加速度

解析：本题考查振动对机体主要的影响因素。频率，振幅，加速度（D对ABCE错）是导致振动对机体作用的主要影响因素。